急性典型菌痢的症状为
A. 黏液脓血便
B. 米泔水样便
C. 酒醉貌
D. 皮肤、巩膜黄染
E. 皮肤粘膜出血点

正确答案：A。黏液脓血便

解析：细菌性痢疾，亦称志贺菌病，简称菌痢，是由志贺菌属痢疾杆菌引起的肠道传染病。该病主要通过消化道传播，好发于夏秋季节。主要病变为直肠、乙状结肠的黏膜呈现溃疡性炎症，多表现为发热、腹痛、腹泻、里急后重、排黏液脓血便（A对）等，重者出现感染性休克和/或中毒性脑病。米泔水样便（B错）为霍乱的典型大便性状改变；酒醉面容（C错）为流行性出血热发热期毛细血管损伤征的典型表现，表现为颜面、颈部、上胸部呈弥漫性潮红，即"三红"征，似酒醉貌；皮肤、巩膜黄染（D错）为黄疸的典型表现；皮肤粘膜出血点（E错）为流行性脑脊髓膜炎的典型表现。